患儿，男，出生时Apgar评分4分，生后2天嗜睡，肌张力减退，瞳孔缩小，时而出现惊厥，头颅CT扫描，可见右叶有低密度影。该患儿的支持疗法应采取哪些措施，除了
A. 供氧
B. 纠正酸中毒
C. 纠正低血糖
D. 静点地塞米松
E. 补液

正确答案：D。静点地塞米松

解析：患儿，出生时Apgar评分4分（提示出生时新生儿轻度窒息），生后2天嗜睡，肌张力减退，瞳孔缩小（新生儿缺氧缺血性脑病的典型临床表现），时而出现惊厥（提示重度），头颅CT扫描，可见右叶有低密度影，根患儿的病史、临床症状、体征及实验室检查，考虑最可能的诊断为新生儿缺氧缺血性脑病，该患儿的支持疗法包括供氧（A对）、纠正酸中毒（B对）、纠正低血糖（C对）、补液（E对），除了静点地塞米松（D错，为本题正确答案）。